糖原分子中一个葡萄糖单位经糖酵解途径分解成乳酸时能净产生多少ATP
A. 1
B. 2
C. 3
D. 4
E. 5

正确答案：B。2

解析：糖酵解分为二个阶段。一分子的PGAL在酶的作用下生成一分子的丙酮酸。在此过程中，发生一次氧化反应生成一个分子的NADH，发生两次底物水平的磷酸化，生成2分子的ATP。这样，一个葡萄糖分子在糖酵解的第二阶段共生成4个ATP和2个NADH+H+，产物为2个丙酮酸。在糖酵解的第一阶段，一个葡萄糖分子活化中要消耗2个ATP，因此在糖酵解过程中一个葡萄糖生成2分子的丙酮酸的同时，净得2分子ATP，2分子NADH和2分子水。掌握“糖分解”知识点。